引起牙龈炎最主要的细菌是
A. 革兰阳性杆菌
B. 革兰阴性杆菌
C. 螺旋体
D. 衣原体
E. 黏性放线菌

正确答案：E。黏性放线菌

解析：本题考查各型牙周病有关的致病菌。细菌是牙周病的始动因子。引起牙龈炎最主要的细菌是黏性放线菌（E对）。革兰阳性杆菌（A错）是化脓性感染的致病菌。革兰阴性杆菌（B错）是溶血性感染的主要致病菌。螺旋体（C错）是坏死性溃疡性牙龈炎的主要致病菌之一。衣原体（D错）是尿道炎和前列腺炎的主要致病菌。